临床上，阿托品可用于治疗
A. 窦性心动过速
B. 虹膜睫状体炎
C. 胃肠绞痛
D. 有机磷酸酯类中毒
E. 感染性休克伴高热

正确答案：B、C、D。虹膜睫状体炎；胃肠绞痛；有机磷酸酯类中毒